扩张型心肌病典型的超声心动图改变是
A. 收缩期心尖部向外膨出
B. 瓣膜增厚、钙化、僵硬，瓣口开放受限
C. 心腔扩大，室壁运动弥漫减弱，瓣口开放小
D. 收缩期二尖瓣前叶向前运动
E. 舒张期室间隔厚度与左室后壁之比≥1.3

正确答案：C。心腔扩大，室壁运动弥漫减弱，瓣口开放小

解析：超声心动图是诊断及评估扩张型心肌病（DCM）最常用的检查手段。DCM早期可仅表现为左心室轻度扩大，后期各心腔均扩大，致二尖瓣、三尖瓣关闭不全，室壁运动普遍减弱（C对）。收缩期心尖部向外膨出（A错）为心室壁瘤的超声心动图改变。瓣膜增厚、钙化、僵硬，瓣口开放受限（B错）仅提示瓣膜发生病变，并无特异性。收缩期二尖瓣前叶向前运动（D错）又称SAM现象，是肥厚梗阻型心肌病的特点。舒张期室间隔厚度与左室后壁之比≥1.3（E错）是肥厚型心肌病（P266）的超声心动图改变。